按照正常的生理状况，牙齿的牙本质增龄性变化生成的牙本质为
A. 原发性牙本质
B. 继发性牙本质
C. 前期牙本质
D. 修复性牙本质
E. 反应性牙本质

正确答案：B。继发性牙本质

解析：本题考查牙本质。继发性牙本质（B对）是牙齿在正常生理情况下的一种牙本质增龄性改变。修复性牙本质也称为第三期牙本质，或反应性牙本质，是牙本质受到疾病因子刺激时的病理性改变。